右旋糖酐20分子量与分子量分布的测定，《中国药典》采用的方法是
A. 非水溶液滴定法
B. 分子排阻色谱法
C. 气相色谱法
D. 氧化还原滴定法
E. 离子交换色谱法

正确答案：B。分子排阻色谱法